腐殖质是
A. 有机含氮化合物分解形成的最简单的无机成分
B. 化学性质不稳定的复杂有机物
C. 动植物残体在微生物作用下形成简单的化合物的同时又重新合成复杂的高分子化合物
D. 土壤中有机物厌氧分解形成的高分子化合物
E. 腐殖质成分很单一

正确答案：C。动植物残体在微生物作用下形成简单的化合物的同时又重新合成复杂的高分子化合物

解析：本题考查腐殖质。腐殖质是动植物残体在微生物作用下形成简单的化合物的同时又重新合成复杂的高分子化合物（C对ABDE错）。